病毒感染机体后，在体内由局部向远处扩散的方式不包括
A. 沿神经播散
B. 经血行播散
C. 经淋巴播散
D. 经组织间隙播散
E. 经免疫系统播散

正确答案：E。经免疫系统播散

解析：病毒感染机体后，在体内由局部向远处扩散的方式包括：经血流播散；经淋巴液播散；经神经系统播散等，经免疫系统播散不是体内由局部向远处扩散的方式（E错ABCD对）。